同一问卷在不同时间对同一研究对象进行重复测量，两次测量结果之间的一致性程度是检验问卷的
A. 信度
B. 效度
C. 可行性
D. 真实性
E. 逻辑性

正确答案：A。信度

解析：本题考查信度。同一问卷在不同时间对同一研究对象进行重复测量，两次测量结果之间的一致性程度是检验问卷的信度（A对BCDE错）。